白及的原植物属于
A. 百合科
B. 天南星科
C. 兰科
D. 姜科
E. 百部科

正确答案：C。兰科

解析：本题考查的是白及的来源。白及的原植物属于兰科（C对）。白及：【来源】为兰科植物白及的干燥块茎。来源于百合科（A错）的中药有黄精、知母、川贝母、浙贝母、玉竹、重楼、土茯苓、天冬、麦冬、山麦冬等。来源于天南星科（B错）的中药有天南星、半夏、石菖蒲等。来源于姜科（D错）的中药有莪术、姜黄、郁金、砂仁、草果、豆蔻、草豆蔻、益智等。来源于百部科（E错）的中药有百部等。